对《中国药典》规定的项目与要求的理解，错误的是
A. 如果注射剂规格为“1ml：10mg”，是指每支装量为1ml，含有主药10mg
B. 如果片剂规格为“0.1g”，是指每片中含有主药0.1g
C. 贮藏条件为“密闭”，是指将容器密闭，以防止尘土及异物进入
D. 贮藏条件为“遮光”，是指用不透光的容器包装
E. 贮藏条件为“在阴凉处保存”，是指保存温度不超过10℃

正确答案：E。贮藏条件为“在阴凉处保存”，是指保存温度不超过10℃

解析：本题考查药品质量标准各项下的内容。对《中国药典》规定的项目与要求的理解，错误的是贮藏条件为“在阴凉处保存”，是指保存温度不超过10℃（E错，为本题正确答案）。贮藏条件为“在阴凉处保存”，是指保存温度不超过20℃。根据规格的定义可知：如果注射剂规格为“1ml：10mg”，是指每支装量为1ml，含有主药10mg（A对）。如果片剂规格为“0.1g”，是指每片中含有主药0.1g（B对）。贮藏条件为“密闭”，是指将容器密闭，以防止尘土及异物进入（C对）。贮藏条件为“遮光”，是指用不透光的容器包装（D对）。